下列哪项不属于个体防护措施
A. 正确选择和使用个体防护用品
B. 遵守安全操作规程
C. 良好的个人卫生习惯
D. 按时接受职业性体检
E. 限制接触时间

正确答案：D。按时接受职业性体检